检查阿司匹林中的游离水杨酸应使用的试剂是
A. 氯化钡
B. 硝酸银
C. 溴化汞
D. 硫代乙酰胺
E. 硫酸铁铵

正确答案：E。硫酸铁铵